可减少唾液中能吸附到牙面上的细菌数量的是
A. 氯己定
B. 酚类化合物
C. 季铵化合物
D. 氟化亚锡
E. 三氯羟苯醚

正确答案：A。氯己定

解析：本题考查化学制剂控制菌斑。可减少唾液中能吸附到牙面上的细菌数量的是氯己定（A对）。常用控制菌斑的化学制剂：1.氯己定又称洗必泰，化学名称为双氯苯双胍己烷，是二价阳离子表面活性剂。氯己定的作用机制主要是减少细菌在牙面的黏附和定殖。氯己定主要用于局部含漱、涂擦和冲洗。常用剂型为0.12%或0.2%的含漱液。使用方法是每天早晚2次，每次10mL，在刷牙和使用牙线之后含漱1分钟，可减少45%～61%的菌斑，减少27%～67%龈炎的发生。氯己定溶液长期使用可能会出现牙面染色，味苦，轻度黏膜刺激等，应遵医嘱。2.酚类化合物（B错）又称香精油，主要为麝香草酚、薄荷醇和甲基水杨酸盐混合而成的抗菌制剂，常用作含漱液。每天2次使用含香精油的含漱液与不使用者相比，6个月后可减少28%的菌斑，减少16%的龈炎的发生。3.季铵化合物（C错）是一组阳离子表面活性剂，对革兰阳性菌有较强的杀灭作用。常用剂型为0.05%的含漱液，可抑制菌斑的形成和龈炎的发生。4.三氯羟苯醚（E错）是一种广谱抗菌剂，主要用于牙膏、含漱液等。